白疕反复不愈，皮肤呈斑块状，鳞屑较厚，颜色暗红，舌紫暗，脉细缓。证属
A. 血热内蕴证
B. 血虚风燥证
C. 气血壅滞证
D. 湿毒蕴阻证
E. 火毒炽盛证

正确答案：C。气血壅滞证

解析：白疕，气血瘀滞证，皮损反复不愈，皮疹多呈斑块状，鳞屑较厚，颜色暗红白疕；舌质紫暗有瘀点、瘀斑，脉涩或细缓（C对）。血热内蕴证，皮疹多呈点滴状，发展迅速，颜色鲜红，层层鳞屑，瘙痒剧烈，刮去鳞屑有点状出血；伴口干舌燥，咽喉疼痛，心烦易怒，便干溲赤；舌质红，苔薄黄，脉弦滑或数（A错）。血虚风燥证，病程较久，皮疹多呈斑片状，颜色淡红，鳞屑减少，干燥皲裂，自觉瘙痒；伴口咽干燥；舌质淡红，苔少，脉沉细（B错）。湿毒蕴积证，皮损多发生在腋窝、腹股沟等皱褶部位，红斑糜烂有渗出，痂屑黏厚，瘙痒剧烈，或表现为掌跖红斑、脓疱、脱皮；或伴关节酸痛、肿胀，下肢沉重；舌质红，苔黄腻，脉滑（D错）。火毒炽盛证，全身皮肤潮红、肿胀，大量脱皮，或有密集小脓疱，伴局部灼热痒痛；壮热畏寒，头身疼痛，口渴欲饮，便干溲赤；舌质红绛，苔黄腻，脉弦滑数（E错）。